女，65岁，头部外伤后昏迷2小时。查体：中度昏迷，右侧瞳孔散大。对光反射消失，左侧肢体肌张力增高，病理征（+）。头颅CT示右额颞部高密度新月形影。最可能的诊断是
A. 急性硬脑膜下血肿
B. 急性硬脑膜外血肿
C. 急性硬脑膜下积液
D. 脑挫伤
E. 脑内血肿

正确答案：A。急性硬脑膜下血肿

解析：老年女性患者，头部外伤后昏迷（脑挫裂伤的表现），查体见右侧瞳孔散大，对光反射消失，左侧肢体肌张力增高，病理征（+）（提示右侧小脑幕切迹疝），头颅CT示右额颞部高密度新月形影（硬膜下血肿的典型影像学表现），结合患者病史、临床表现和影像学检查，应诊断为右侧额颞部急性硬脑膜下血肿（A对）合并小脑幕切迹疝。急性硬脑膜外血肿（P191）（B错）的典型CT表现为颅骨内板和硬脑膜之间双凸透镜形或弓形的高密度影。急性硬脑膜下积液（C错）CT表现为额颞顶部新月状低密度影。脑挫伤（P188）（D错）可有意识障碍、头痛、恶心、呕吐等表现，轻者生命体征无明显变化，CT扫描典型表现为局部脑组织内高低密度混杂影。脑内血肿（P194）（E错）常与硬膜下血肿同时存在，CT表现为脑挫裂伤区附近或脑深部白质内类圆形或不规则高密度影。